与造成孕妇死胎无关的病因是
A. 孕妇因素
B. 胎儿因素
C. 胎盘因素
D. 孕妇营养不良
E. 脐带因素

正确答案：D。孕妇营养不良